环烯醚萜的结构中有
A. 黄酮结构单元
B. 黄酮醇结构单元
C. 双键结构单元
D. 半缩醛结构单元
E. 香豆素结构单元

正确答案：C、D。双键结构单元；半缩醛结构单元

解析：本题考查的是环烯醚萜的结构。环烯醚萜的结构中有双键结构单元（C对）、半缩醛结构单元（D对）。环烯醚萜类的基本母核为环烯醚萜醇，具有半缩醛及环戊烷环的结构特点，其半缩醛1位羟基性质不稳定，故环烯醚萜类化合物主要以1位羟基与糖成苷的形式存在于植物体内。根据其环戊烷环是否裂环，可将环烯醚萜类化合物分为环烯醚萜苷及裂环环烯醚萜苷两大类。